燥邪犯肺证，可见
A. 咳嗽，咯痰稀白
B. 咳嗽，痰多泡沫
C. 咳喘，咯痰黄稠
D. 咳嗽，痰少难咯且喘
E. 痰多易咯

正确答案：D。咳嗽，痰少难咯且喘

解析：燥邪犯肺，肺气失宣，故咳嗽；燥邪袭肺，肺气失宣，津液不布，燥性干涩伤津，故痰少难咯且喘，故燥邪犯肺证可见咳嗽，痰少难咯且喘（D对）。咳嗽，咯痰稀白（A错）可见于风寒犯肺证，因寒邪阻肺，津凝不化，凝而成痰所致。咳喘，咯痰黄稠（C错）可见于热邪壅肺证，因邪热犯肺，煎津为痰所致。咳嗽，痰多泡沫（B错）可见于寒痰阻肺证，因寒邪阻肺，津凝不化，凝而成痰所致。痰多易咯多属痰浊阻肺所致（E错）。